室间隔缺损和动脉导管未闭患儿压迫喉返神经是由于
A. 肺动脉扩张
B. 主动脉扩张
C. 右心房扩张
D. 左心房扩张
E. 左、右心房扩张

正确答案：A。肺动脉扩张

解析：由于室间隔缺损和动脉导管未闭患儿肺动脉扩张压迫喉返神经而引起声音嘶哑。左心室压力比右心室压力高，室间隔缺损时会出现一部分血流经室间隔缺损分流入右心室到肺动脉至肺循环，造成肺动脉高压及肺动脉扩张。同样主动脉血压明显高于肺动脉，动脉导管未闭会出现大量血液从主动脉通过导管流向肺动脉，从而出现肺动脉高压及肺动脉扩张（A对）。小儿主动脉扩张（B错）多见于马凡氏综合征。由于喉返神经位置较高，左、右心房扩张（CDE错）都很难累及喉返神经。